能补血又滋阴的药是
A. 阿胶
B. 白芍
C. 何首乌
D. 龙眼肉
E. 紫河车

正确答案：A。阿胶

解析：本题考查的是阿胶的功效。能补血又滋阴的药是阿胶（A对）。阿胶：【功效】补血止血，滋阴润燥。白芍（B错）：【功效】养血调经，敛阴止汗，柔肝止痛，平抑肝阳。何首乌（C错）：【功效】补益精血，解毒，截疟，润肠通便。龙眼肉（D错）：【功效】补心脾，益气血，安心神。紫河车（E错）：【功效】温肾补精，养血益气。